白细胞分化抗原是指
A. 白细胞表面的全部膜分子
B. T淋巴细胞表面的膜分子
C. B淋巴细胞表面的膜分子
D. 造血干细胞在分化为不同谱系淋巴细胞及其活化过程中，出现或消失的细胞表面标志
E. TCR和BCR

正确答案：D。造血干细胞在分化为不同谱系淋巴细胞及其活化过程中，出现或消失的细胞表面标志